问卷的结构一般包括
A. 首页、题目、指导语
B. 首页、指导语、题目、结束语
C. 首页、题目、结束语
D. 首页、过渡语、题目
E. 首页、题目、联结部分

正确答案：E。首页、题目、联结部分

解析：本题考查问卷的结构。问卷的结构一般包括首页、题目、联结部分（E对）。问卷的结构一般包括首页、题目以及联结部分。联结部分有指导语、过渡语等，由它们将题目按照逻辑顺序联结成整体。1.首页：首页即问卷的第一页，含封面信、调查对象编码和基本情况、调查日期等。封面信是致调查对象的短信，说明组织该调查的机构、目的和意义、主要内容和对象的选择，并有保密承诺和感谢语，常放在问卷的封面，也可以单独发放。2.题目：题目是问卷的核心部分，通过题目可获得所需信息。一个完整的题目由问题、答案和编码三部分组成。3.联结部分：（1）指导语：是指用于指导调查对象如何正确填答问卷，调查员如何正确完成问卷的一组陈述。根据所处位置不同，指导语又可分为卷头指导语和卷中指导语。卷头指导语常以填表说明的形式出现，卷中指导语一般是针对某些问题所作出的特定指示。（2）过渡语：问卷中当开始一个新的话题时，应有过渡语，以免被调查人感到突然，不能适应。（3）结束语：在问卷的最后，可简短地对调查对象表示谢意，也可征询调查对象对问卷设计和问卷调查本身的看法和感受。